鼓室的后壁有
A. 乳突窦的开口
B. 咽鼓管的开口
C. 岬
D. 前庭窗
E. 内有三个半规管和两块小肌肉

正确答案：A。乳突窦的开口

解析：岬（C错）和前庭窗（D错）均位于鼓室的内侧壁上。咽鼓管开口（B错）于鼓室前壁。乳突窦的开口（A对）位于后壁上。只有镫骨肌位于后壁上（E错）。